完整的毒理学评价可划分四个阶段的实验研究，下述哪一项描述是错误的
A. 第一阶段进行急性毒性试验
B. 第二阶段进行亚急性毒性试验和致突变试验
C. 第三阶段进行亚慢性毒性试验和代谢试验
D. 第四阶段是进行人群接试验研究

正确答案：D。第四阶段是进行人群接试验研究

解析：本题考查毒理学评价的阶段。我国现行的毒理学评价程序大部分是把毒理学试验分为四个阶段：1.第一阶段急性毒性试验（A对）和局部毒性评价；2.第二阶段：一般包括遗传毒理学试验和致畸试验（B对）；3.第三阶段：一般包括亚慢性毒性试验、繁殖试验和代谢试验（C对）；4.第四阶段：包括慢性毒性试验和致癌试验（D错，为本题正确答案）。